不属于成釉细胞瘤常见分类的是
A. 滤泡型
B. 丛状型
C. 溃疡型
D. 棘皮瘤型
E. 颗粒细胞型

正确答案：C。溃疡型

解析：成釉细胞瘤的组织结构和细胞形态变异较大，可有多种表现包括：滤泡型、丛状型、棘皮瘤型、颗粒细胞型、基底细胞型、角化成釉细胞瘤。无溃疡型。掌握“成釉细胞瘤”知识点。